某女，42岁。患滴虫、霉菌引起的阴道炎、外阴炎，症见带下量多、色黄味臭、阴部瘙痒。证属湿热下注，宜选用的成药是
A. 坤宝丸
B. 乳癖消胶囊
C. 妇科千金片
D. 千金止带丸
E. 妇炎平胶囊

正确答案：E。妇炎平胶囊

解析：本题考查的是妇炎平胶囊的主治。患滴虫、霉菌引起的阴道炎、外阴炎，症见带下量多、色黄味臭、阴部瘙痒。证属湿热下注，宜选用的成药是妇炎平胶囊（E对）。妇炎平胶囊：【主治】湿热下注所致的带下病、阴痒，症见带下量多、色黄味臭、阴部瘙痒；滴虫、霉菌、细菌引起的阴道炎、外阴炎见上述证候者。坤宝丸（A错）：【主治】肝肾阴虚所致的绝经前后诸证，症见烘热汗出、心烦易怒、少寐健忘、头晕耳鸣、口渴咽干、四肢酸楚；更年期综合征见上述证候者。乳癖消胶囊（B错）：【主治】痰热互结所致的乳癖、乳痈，症见乳房结节、数目不等、大小形态不一、质地柔软，或产后乳房结块、红热疼痛；乳腺增生、乳腺炎早期见上述证候者。妇科千金片（C错）：【主治】湿热瘀阻所致的带下病、腹痛，症见带下量多、色黄质稠、臭秽、小腹疼痛、腰骶酸痛、神疲乏力；慢性盆腔炎、子宫内膜炎、慢性宫颈炎见有上述证候者。千金止带丸（D错）：【主治】脾肾两虚所致的月经不调、带下病，症见月经先后不定期、量多或淋沥不净、色淡无块，或带下量多、色白清稀、神疲乏力、腰膝酸软。